影响农作物农药残留的因素有
A. 农作物的品种
B. 施药到收获的时间间隔
C. 环境、气象条件
D. 农药品种
E. 以上都是

正确答案：E。以上都是